贫血虫积证，治疗应首选的方剂是
A. 香砂六君子汤合当归补血汤
B. 归脾汤
C. 八珍汤合无比山药丸
D. 化虫丸合八珍汤
E. 桃红四物汤

正确答案：D。化虫丸合八珍汤

解析：贫血虫积证是由于各种寄生虫侵入人体，日久脾胃受损，同时又大量吸收了人体精微，导致生化乏源，引起贫血，治宜补益气血，杀虫消积，方选化虫丸合八珍汤（D对）。香砂六君子汤主治贫血脾胃气虚证，当归补血汤主治贫血血虚发热证（A错）。归脾汤主治心脾气血两虚证，脾不统血证（B错）。劳淋治疗用方无比山药丸（C错）。桃红四物汤治疗血虚兼血瘀证（E错）。